天疱疮病理改变的主要部位是
A. 上皮基底膜
B. 上皮基底细胞
C. 上皮棘层细胞
D. 上皮粒层细胞
E. 上皮角化层

正确答案：C。上皮棘层细胞

解析：天疱疮是一种少见而严重的疱性、自身免疫性疾病，在疾病过程中约有90%的患者累及口腔黏膜。发生于口腔黏膜者主要为寻常性天疱疮。其病理变化：天疱疮的病理特征为棘层松解和上皮内疱形成。由于上皮细胞间水肿，细胞间桥消失，使棘层细胞松解，彼此分离，在上皮内形成裂隙或出现大疱，其部位常在棘层内或棘层和基底层之间。掌握“口腔黏膜基本病理变化”知识点。